一对年轻夫妇计划出国旅游，出发前，准备选购以下治疗腹泻的药物备用，包括蒙脱石、口服补液盐、双歧杆菌三联活菌、洛哌丁胺，小檗碱。下列药物中，需凭医师处方购买的药物是
A. 蒙脱石
B. 口服补液盐
C. 双歧杆菌三联活菌
D. 洛哌丁胺
E. 小檗碱

正确答案：D。洛哌丁胺

解析：本题考查处方药。需凭医师处方购买的药物是洛哌丁胺（D对）。洛哌丁胺属于处方药，需凭医师处方购买。蒙脱石（A错）、口服补液盐（B错）、双歧杆菌三联活菌（C错）、小檗碱（E错）均为非处方药。